与氨茶碱合用对急性哮喘治疗作用加强
A. 异烟肼
B. 亚胺培南
C. 沙丁胺醇
D. 阿莫西林
E. 氨苯蝶啶

正确答案：C。沙丁胺醇

解析：本题考查药物的联合应用。与氨茶碱合用对急性哮喘治疗作用加强的是沙丁胺醇（C对）。沙丁胺醇为短效β₂受体激动剂，是治疗哮喘急性发作的首选用药，与氨茶碱合用对急性哮喘治疗作用加强。异烟肼（A错）为抗结核病药。亚胺培南（B错）为碳青霉烯类抗生素。阿莫西林（D错）为β-内酰胺类抗菌药。氨苯蝶啶（E错）为保钾利尿药。